男性，20岁，外地来广州学生，高热3天，抽搐、意识障碍1天入院，体检体温40℃，呼吸30次/分，颈抵抗，病理神经反射阳性，四肢肌张力增高，外周血象白细胞20×10⁹/L，中性粒细胞比例为92％，尿蛋白（+），为明确诊断，下列检查中最重要的是
A. 血培养
B. 乙脑特异性抗体检查
C. 脑脊液检查
D. 病毒分离
E. 流行性出血热抗体检查

正确答案：B。乙脑特异性抗体检查